通过检测供血者的HIV抗体来保护受血者属于
A. 一级预防
B. 二级预防
C. 三级预防
D. 常规报告
E. 哨点监测

正确答案：A。一级预防

解析：本题考查一级预防。第一级预防又称病因预防，是在疾病（或伤害）尚未发生时针对病因或危险因素采取措施，降低有害暴露的水平，增强个体对抗有害暴露的能力，预防疾病（或伤害）的发生，或至少推迟疾病的发生。通过检测供血者的HIV抗体来保护受血者属于一级预防（A对BCDE错）。